某男，38岁。因外感病邪犯少阳导致寒热往来，胸胁苦满，食欲不振，心烦喜呕，口苦咽干。治当解表散热、疏肝和胃，宜选用的成药是
A. 四逆散
B. 逍遥丸
C. 小柴胡颗粒
D. 柴胡舒肝丸
E. 气滞胃痛颗粒

正确答案：C。小柴胡颗粒

解析：本题考查的是小柴胡颗粒的功能。因外感病邪犯少阳导致寒热往来，胸胁苦满，食欲不振，心烦喜呕，口苦咽干。治当解表散热、疏肝和胃，宜选用的成药是小柴胡颗粒（C对）。小柴胡颗粒：【功能】解表散热，疏肝和胃。四逆散（A错）：【功能】透解郁热，疏肝理脾。逍遥丸（B错）：【功能】疏肝健脾，养血调经。柴胡舒肝丸（D错）：【功能】疏肝理气，消胀止痛。气滞胃痛颗粒（E错）：【功能】疏肝理气，和胃止痛。